痛风时尿沉渣结晶为
A. 草酸盐结晶
B. 尿酸盐结晶
C. 磷酸盐结晶
D. 酪氨酸结晶
E. 胆红素结晶

正确答案：B。尿酸盐结晶

解析：本题考查尿常规检查。痛风时的尿沉渣结晶为尿酸盐结晶（B对）。大量的的草酸盐结晶提示严重的慢性肾病，或乙二醇、甲氧氟烷中毒（A错）。磷酸盐结晶（C错）常见于pH碱性的感染性尿液。酪氨酸结晶（D错）常见于有严重肝病的患者尿液中。胆红素结晶（E错）见于黄疸、急性肝萎缩、肝癌、肝硬化、磷中毒等患者的尿液中。